根据PRECEDE模式，健康教育诊断首要步骤是
A. 流行病学诊断
B. 行为诊断
C. 社会诊断
D. 教育与组织诊断
E. 环境诊断

正确答案：C。社会诊断